关于干扰素的特性，哪项错误
A. 具有抗肿瘤、免疫调节作用
B. 具有种属特异性
C. 具有直接杀灭病毒作用
D. 具有广谱抗病毒作用
E. 属于非特异性免疫因素

正确答案：C。具有直接杀灭病毒作用